关于继发性肾病综合征的特点下列说法错误的一项是
A. 过敏性紫癜好发于青少年
B. 系统性红斑狼疮好发于青壮年女性
C. 乙肝病毒相关性肾炎其肾脏病理以膜性肾炎最为多见
D. 糖尿病肾病多见于10年以上病程的糖尿病患者
E. 肾淀粉样变肾脏受累进展急速

正确答案：E。肾淀粉样变肾脏受累进展急速

解析：继发性肾病综合征的原因及主要特点为：过敏性紫癜好发于青少年；系统性红斑狼疮好发于青壮年女性；乙肝病毒相关肾炎可发生于任何年龄，儿童和青少年中多见，肾脏病理以膜性肾病最为多见；糖尿病肾病多见于病程10年以上的糖尿病患者；肾淀粉样变是一种全身性疾病，肾脏受累进程多缓慢。掌握“慢性肾小球肾炎、肾病综合征”知识点。